著是
A. 《刘涓子鬼遗方》
B. 《五十二病方》
C. 《金创瘈疭方》
D. 《山海经》
E. 《内经》

正确答案：E。《内经》

解析：本题考查历史沿革，要求理解记忆。《刘涓子鬼遗方》最早记载了用局部有无波动感来辨脓，首创用水银膏治疗皮肤病（A错）。《五十二病方》是现存最早的医书，书中已有痈、疽、创伤、痔疾、皮肤病等外科疾病的记载，并叙述了砭法、灸法、熨法、熏法、角法、按摩等疗法（B错）。《金创瘈疭方》为我国第一部外科专著，已佚（C错）。《山海经》载有38种疾病，其中包括痈、疽、痹、瘿、痔、疥等外科疾病（D错）。《内经》建立了中医药学系统的理论基础，涉及外科疾病近30种，记载了针砭、按摩、猪膏外敷等多种外治方法，并最早提出用截趾手术治疗脱疽（E对）。